能与氨基酸加热产生有色沉淀的是
A. 柠檬烯
B. 鱼腥草素
C. 龙胆苦苷
D. 新穿心莲内酯
E. 丁香酚

正确答案：C。龙胆苦苷

解析：本题考查的是环烯醚萜类的显色反应及检识。能与氨基酸加热产生有色沉淀的是龙胆苦苷（C对）。环烯醚萜类：环烯醚萜类为臭蚁二醛的缩醛衍生物，属单萜类化合物。环烯醚萜类化合物在中药中分布较广，特别是在玄参科、茜草科、唇形科及龙胆科中较为常见。环烯醚萜类的基本母核为环烯醚萜醇，具有半缩醛及环戊烷环的结构特点。根据其环戊烷环是否裂环，可将环烯醚萜类化合物分为环烯醚萜苷及裂环环烯醚萜苷两大类。1）环烯醚萜苷：①C-4位有取代基的环烯醚萜苷：C-4位取代基多为甲基或羧基、羧酸甲酯、羟甲基。如栀子中的栀子苷、京尼平苷、京尼平苷酸，鸡屎藤中的鸡屎藤苷。②4-去甲基环烯醚萜苷：环烯醚萜苷C-4位去甲基降解苷，苷元碳架部分由9个碳组成。如地黄中的梓醇、梓苷。2）裂环环烯醚萜苷：此类化合物是由环烯醚萜苷元部分C-7和C-8位处开环衍生而来，C-7断裂后有时还可与C-11形成六元内酯结构。裂环环烯醚萜苷在龙胆科、睡菜科、茜草科、忍冬科、木犀科等植物中分布较广，在龙胆科的龙胆属及獐牙菜属分布更为普遍。如龙胆中的龙胆苦苷，獐牙菜中的獐牙菜苷及獐牙菜苦苷等。环烯醚萜化合物的显色反应及检识：环烯醚萜苷易被水解，生成的苷元为半缩醛结构，其化学性质活泼，容易进一步发生氧化聚合等反应，难以得到结晶性苷元，同时使颜色变深，如地黄及玄参等中药在炮制及放置过程中因此而变成黑色。苷元遇酸、碱、羰基化合物和氨基酸等都能变色。如车叶草苷与稀酸混合加热，能被水解、聚合产生棕黑色树脂状聚合物沉淀；若用酶水解，则显深蓝色，也不易得到结晶性苷元。游离的苷元遇氨基酸并加热，即产生深红色至蓝色，最后生成蓝色沉淀。因此，与皮肤接触，也能使皮肤染成蓝色。苷元溶于冰醋酸溶液中，加少量铜离子，加热显蓝色。这些显色反应，可用于环烯醚萜苷的检识及鉴别。柠檬烯（A错）属于挥发油，为薄荷、莪术、荆芥、枳壳等中药的主要化学成分之一。鱼腥草素（B错）属于挥发油中的脂肪族化合物，为鱼腥草挥发油的化学成分之一。新穿心莲内酯（D错）属于二萜内酯苷类成分，为穿心莲的主要化学成分之一。穿心莲叶中含有多种二萜内酯及二萜内酯苷类成分，如穿心莲内酯、新穿心莲内酯、14-去氧穿心莲内酯、脱水穿心莲内酯等。其中穿心莲内酯含量最高，为其主要活性成分。丁香酚（E错）属于挥发油中的单萜类衍生物，为艾叶的主要化学成分之一。艾叶的化学成分主要有挥发油、黄酮和三萜类成分。其中艾叶含挥发油0.45%～1.00%，《中国药典》以桉油精（桉叶素）和龙脑为指标成分，采用气相色谱法进行含量测定，要求桉油精不得少于0.050%，含龙脑不得少于0.020%。艾叶挥发油主要包括单萜类化合物、单萜类衍生物、倍半萜类化合物及其衍生物，其中30种单萜类衍生物占挥发油的79.20%，是艾叶挥发油的主要组成部分，包括1，8-桉树脑、茨烯、香桧烯、1-辛烯-3-醇、樟脑、α-松油醇、丁香酚等。